女，3岁。自幼呼吸较急促，消瘦，乏力，常患呼吸道感染。剧烈哭吵时，唇周青紫，体检胸骨左缘第3～4肋间可闻及3，4级粗糙的收缩期杂音，X线检查左右心室增大，肺动脉段突出，可见肺门“舞蹈”，最可能的诊断是
A. 房间隔缺损
B. 室间隔缺损
C. 动脉导管未闭
D. 肺动脉狭窄
E. 法洛四联征

正确答案：B。室间隔缺损

解析：患儿“呼吸急促，常患呼吸道感染”，提示肺部循环血量高，肺部有血液淤积、“剧烈哭吵时，唇周青紫”提示有效循环血量不足，存在血液分流，由于患儿仅在剧烈哭吵是有唇周青紫，并无艾森曼格综合征的表现（E错），因此可判断存在左向右分流。“胸骨左缘第3-4肋间可闻及3，4级粗糙的收缩期杂音”，提示缺损位于室间隔（B对）。